英国海军外科医生将12名坏血病患者分为6组进行对比治疗试验，证实了坏血病是由于缺乏新鲜水果和蔬菜引起的，该研究开创了以下哪种流行病学研究方法的先河
A. 病例对照研究
B. 队列研究
C. 现况研究
D. 临床试验
E. 现场试验

正确答案：D。临床试验

解析：本题考查流行病学发展史。英国海军外科医生将12名坏血病患者分为6组进行对比治疗试验，证实了坏血病是由于缺乏新鲜水果和蔬菜引起的，该研究开创了流行病学临床试验（D对ABCE错）的先河。